根据《互联网药品交易服务审批暂行规定》，关于互联网药品交易服务的说法错误的是
A. 互联网药品交易服务包括直接接触药品的包装材料和容器的互联网交易服务
B. 省级药品监督管理部门负责审批为药品生产、经营企业和医疗机构之间提供互联网药品交易服务的企业
C. 互联网药品交易服务机构资格证书由国家食品药品监督管理局统一印制，有效期为五年
D. 申请向个人消费者提供互联网药品交易服务的企业，至少必须是药品连锁零售企业
E. 提供互联网药品交易服务的企业必须在其网站首页显著位置标明互联网药品交易服务机构资格证书号码

正确答案：B。省级药品监督管理部门负责审批为药品生产、经营企业和医疗机构之间提供互联网药品交易服务的企业

解析：本题考查的是网络药品经营管理。国家药品监督管理局负责审批为药品生产、经营企业和医疗机构之间提供互联网药品交易服务的企业（B错，为本题正确答案）。互联网药品交易服务分为三类：第一类是为药品生产企业、药品经营企业和医疗机构之间的互联网药品交易提供的服务，第一类证书简称A证，由国家药品监督管理局审批发放；第二类为药品生产企业、药品批发企业通过自身网站与本企业成员之外的其他企业进行的互联网药品交易，第二类证书简称B证，由省级药品监督管理部门审批发放；第三类为药品零售连锁企业向个人消费者提供的互联网药品交易服务，第三类证书简称C证，由省级药品监督管理部门审批发放。《互联网药品交易服务审批暂行规定》第二条：在中华人民共和国境内从事互联网药品交易服务活动，必须遵守本规定。本规定所称互联网药品交易服务，是指通过互联网提供药品（包括医疗器械、直接接触药品的包装材料和容器）交易服务的电子商务活动（A对）。第四条：从事互联网药品交易服务的企业必须经过审查验收并取得互联网药品交易服务机构资格证书。互联网药品交易服务机构的验收标准由国家食品药品监督管理局统一制定。互联网药品交易服务机构资格证书由国家食品药品监督管理局统一印制，有效期五年（C对）。第九条：向个人消费者提供互联网药品交易服务的企业，应当具备以下条件：（一）依法设立的药品连锁零售企业（D对）；（二）提供互联网药品交易服务的网站已获得从事互联网药品信息服务的资格；（三）具有健全的网络与交易安全保障措施以及完整的管理制度；（四）具有完整保存交易记录的能力、设施和设备；（五）具备网上咨询、网上查询、生成订单、电子合同等基本交易服务功能；（六）对上网交易的品种有完整的管理制度与措施；（七）具有与上网交易的品种相适应的药品配送系统；（八）具有执业药师负责网上实时咨询，并有保存完整咨询内容的设施、设备及相关管理制度；（九）从事医疗器械交易服务，应当配备拥有医疗器械相关专业学历、熟悉医疗器械相关法规的专职专业人员。《互联网药品交易服务审批暂行规定》第十八条：提供互联网药品交易服务的企业必须在其网站首页显著位置标明互联网药品交易服务机构资格证书号码（E对）。